在咀嚼过程中有关磨耗的描述中，正确的是
A. 牙面与食物之间的摩擦而造成牙齿楔形缺损
B. 牙面与牙面之间的摩擦而造成牙齿缓慢地渐进性消耗
C. 嗑瓜子造成的上下中切牙切缘的楔形缺损属于磨耗
D. 牙齿表面与外物机械性摩擦而产生的牙体组织损耗
E. 以上说法均正确

正确答案：B。牙面与牙面之间的摩擦而造成牙齿缓慢地渐进性消耗

解析：磨耗是指在咀嚼过程中，由于牙面与牙面之间，或牙面与食物之间的摩擦，使牙齿硬组织缓慢地、渐进性消耗的生理现象。磨损一般指牙齿表面与外物机械性摩擦而产生的牙体组织损耗。如嗑瓜子造成的上下中切牙切缘的楔形缺损。掌握“牙动度和唇、舌、腭对咀嚼的作用”知识点。